关于前交叉韧带的描述，正确的是
A. 起自股骨内侧髁外面
B. 伸膝关节时最松弛
C. 限制胫骨过度后移
D. 限制胫骨过度前移
E. 止于胫骨粗隆

正确答案：D。限制胫骨过度前移

解析：前交叉韧带起自胫骨髁间隆起的前方内侧（A错），止于股骨外侧髁的内侧（E错），在伸膝时最紧张（B错），可以防止胫骨前移（D对C错）。